病毒性肝炎属于
A. 变质性炎症
B. 浆液性炎症
C. 增生性炎症
D. 化脓性炎症
E. 出血性炎症

正确答案：A。变质性炎症

解析：病毒性肝炎是由肝炎病毒引起的以肝实质细胞变性、坏死为主病变的一种常见传染病，属于以变质为主的炎症（A对）。浆液性炎症（P75）（B错）是以浆液渗出为特征，主要发生于黏膜、浆膜、滑膜、皮肤和疏松结缔组织等。增生性炎症（C错）是以实质细胞和间质细胞的增生为特征，如伤寒病。化脓性炎症（P75）（D错）多是由化脓菌引起的炎症，病毒性肝炎是由肝炎病毒引起的炎症，并非细菌。出血性炎症（P76）（E错）指炎症病灶的血管损伤严重，而在各型肝炎中少见出血症状。